APC的组成是
A. 阿司匹林+非那西丁+咖啡因
B. 阿司匹林+苯巴比妥+咖啡因
C. 阿司匹林+氨基比林+咖啡因
D. 阿司匹林+非那西丁+可待因
E. 阿托品+非那西丁+可待因

正确答案：A。阿司匹林+非那西丁+咖啡因